一患者主诉左下后牙食物嵌塞，临床：左下78间食物嵌塞，左下8正位且无对颌牙，且过长。此病人解决食物嵌塞的最佳方法是
A. 扩展外展隙
B. 调磨相邻两牙边缘嵴
C. 调磨磨耗小平面
D. 调磨对颌牙尖
E. 拔除左下8

正确答案：E。拔除左下8

解析：此患者引起食物嵌塞是由于左下8无对颌牙而伸长致两牙边缘嵴高度不一致，咬合时来自对颌的力会将食物嵌入两牙之间，一般情况下将伸长的牙齿调磨，与邻牙协调即可，但是左下8无对颌牙，即是一颗无功能的牙，且造成78间食物嵌塞是拔牙的适应症，故拔除左下8（E对）是最佳方法。解决食物嵌塞要对因治疗，扩展外展隙（A错）、调磨相邻两牙边缘嵴（B错）、调磨磨耗小平面（C错）、调磨对颌牙尖（D错）都不能针对该患者的病因进行治疗来解决该患者的嵌塞问题。